仅具备抗原性而无免疫原性的小分子是
A. 完全抗原
B. 半抗原
C. 佐剂
D. 超抗原
E. 补体

正确答案：B。半抗原